用于防治晕车、晕船、晕机，但勿与地西泮和酒精同用，孕妇、新生儿禁用的是
A. 盐酸异丙嗪
B. 马来酸氯苯那敏
C. 盐酸苯海拉明
D. 茶苯海明
E. 盐酸地芬尼多

正确答案：D。茶苯海明